目前发现的能在无活性细胞培养基中繁殖的最小微生物是
A. 衣原体
B. 支原体
C. 立克次体
D. 病毒
E. 真菌

正确答案：B。支原体